大面积烧伤早期发生的休克，多为
A. 神经源性休克
B. 心源性休克
C. 低血容量性休克
D. 过敏性休克
E. 感染性休克

正确答案：C。低血容量性休克

解析：大面积烧伤早期体液大量丢失，可以造成低血容量性休克。掌握“火器伤、热烧伤”知识点。